活体体表可触摸到搏动的动脉，不包括以下的
A. 颞浅动脉
B. 眼动脉
C. 肱动脉
D. 足背动脉
E. 颈总动脉

正确答案：B。眼动脉

解析：颞浅动脉（A对）在外耳门的前上方、颞弓的根部可摸到搏动。肱动脉（C对）可在肱二头肌内侧沟处触知其搏动。足背动脉（D对）在踝关节的前方，内、外踝前方连线的中点、踇长伸肌腱的外侧可触知其搏动。颈总动脉（E对B错为本题正确答案）上段在活体上可摸到其搏动。